幻觉的定义是
A. 缺乏客观刺激作用于感官时的知觉体验
B. 对客观事物的歪曲知觉
C. 人脑对客观事物的一种错误的猜想
D. 在梦幻中的一种知觉体验
E. 人脑的一种丰富想象的思维过程

正确答案：A。缺乏客观刺激作用于感官时的知觉体验

解析：幻觉是没有现实刺激作用于感觉器官时出现的知觉体验（A对），是一种虚幻的知觉。对客观事物的歪曲知觉是错觉（B错）。